流行性腮腺炎可出现腮腺管开口处黏膜红肿，其部位在
A. 上颌第2臼齿相对应的颊黏膜上
B. 下颌第2臼齿相对应的颊黏膜上
C. 舌下
D. 上颌第1臼齿相对应的颊黏膜上
E. 下颌第1臼齿相对应的颊黏膜上

正确答案：A。上颌第2臼齿相对应的颊黏膜上

解析：腮腺位于耳屏、下颌角、颧弓所构成的三角区内，正常腮腺体薄而软，触诊时摸不出腺体轮廓，腮腺肿大时可见到以耳垂为中心的隆起，并可触及边缘不明显的包块。腮腺导管位于颧骨下1.5cm处，横过咀嚼肌表面，开口相当于上颌第2臼齿（磨牙）对应的颊黏膜（A对）。